某女，45岁。患有类风湿性关节炎，长期服用解热镇痛药，近期咽喉肿痛，牙痛，邻居介绍服用新癀片。患者购药时像药师咨询，希望了解该药的更多信息。要是询问患者一般情况和用药目的后，结合病人既往治疗情况，阻止了该患者购买新癀片。药师进一步说明，若加用新癀片，造成解热镇痛药重复使用，会加大不良反应发生的可能性。关于该药发生不良反应的说法，错误的是
A. 有头痛、眩晕风中枢神经系统反应
B. 发生过敏反应常见为皮疹
C. 常具有肠胃道反应
D. 可引起肝肾损害
E. 可引起粒细胞增高

正确答案：E。可引起粒细胞增高

解析：本题考查的是吲哚美辛的不良反应。可引起粒细胞增高（E错，为本题正确答案）。吲哚美辛的不良反应发生率高达35%～50%，其中约20%的患者常因不能耐受而被迫停药。常见的不良反应包括如下几个方面。（1）胃肠道反应（C对）：如恶心、呕吐、厌食、消化不良、胃炎、腹泻，偶有胃溃疡、穿孔、出血。（2）中枢神经系统反应：头痛、眩晕（A对）、困倦，偶有惊厥、周围神经痛、晕厥、精神错乱等。（3）造血系统损害：可有粒细胞、血小板减少，偶有再生障碍性贫血。（4）过敏反应：常见为皮疹（B对）、哮喘、呼吸抑制、血压下降等。（5）可引起肝肾损害（D对）。鉴此，溃疡病、哮喘、帕金森病和精神病患者以及孕妇、哺乳期妇女禁用；14岁以下儿童一般不用；老年患者及心功能不全、高血压、肝肾功能不全、出血性疾病患者慎用；且不宜与阿司匹林、丙磺舒、钾盐、氨苯蝶啶合用。